治疗痛经气滞血瘀证，应首选
A. 血府逐疲汤
B. 膈下逐瘀汤
C. 少腹逐瘀汤
D. 身痛逐瘀汤
E. 通窍活血汤

正确答案：B。膈下逐瘀汤

解析：痛经气滞血瘀证主要因为肝失条达，冲任气血郁滞，经血不利，不通则痛，因此治疗时要理气行滞，化瘀止痛，故采用膈下逐瘀汤（B对）。血府逐瘀汤所主治的诸证皆为瘀血阻止胸部，气机郁滞所致，表现为胸痛头痛日久不愈，痛如针刺而有定处（A错）。少腹逐瘀汤功用活血祛瘀，温经止痛。主治：寒凝血淤证。少腹瘀血积块疼痛或不痛，或痛而无积块，或少腹胀满，或经期腰酸，少腹作胀（C错）。身痛逐瘀汤功用活血行气，祛瘀通经，通痹止痛。主治瘀血痹阻经络证。肩痛，臂痛，腰痛，或周身疼痛，经久不愈（D错）。通窍活血汤功用活血通窍。主治瘀阻头面证。头痛昏晕，或耳聋，脱发，面色青紫，或酒糟鼻，或白癜风；以及妇女干血痨，小儿疳积见肌肉消瘦，腹大青筋，潮热等（E错）。